某女，40岁。素体虚弱，经寒痛经，此次行经已10日，至今漏下不止，色淡红，舌质胖淡，苔薄白。治当温经止血、散寒止痛，宜选用的药是
A. 茜草
B. 三七
C. 槐花
D. 艾叶
E. 苎麻根

正确答案：D。艾叶

解析：本题考查的是艾叶的功效。素体虚弱，经寒痛经，此次行经已10日，至今漏下不止，色淡红，舌质胖淡，苔薄白。治当温经止血、散寒止痛，宜选用的药是艾叶（D对）。艾叶：【功效】温经止血，散寒止痛。茜草（A错）：【功效】凉血，祛瘀，止血，通经。三七（B错）：【功效】化瘀止血，活血定痛。槐花（C错）：【功效】凉血止血，清肝泻火。苎麻根（E错）：【功效】凉血止血，清热安胎，利尿，解毒。